患者水肿反复消长不已，面浮肢肿腰以下为甚，按之凹陷不起，心悸，气短，腰部冷痛，尿少，四肢冷，舌质淡胖，苔薄白，脉沉细。其证候是
A. 脾阳虚衰证
B. 水湿浸渍证
C. 湿毒浸淫证
D. 湿热壅盛证
E. 肾阳虚衰正

正确答案：E。肾阳虚衰正

解析：题中患者水肿为主，面浮肢肿，诊断为水肿，腰以下甚，按之凹陷不起，故为阴水。腰部冷痛，尿少，四肢冷等为肾阳虚衰，水寒内聚所致，皆为肾阳虚衰证的表现（E对）。脾阳虚衰之水肿的临床表现主要为身肿日久，腰以下甚，按之凹陷不易恢复，脘腹胀闷，纳减便溏，面色不华等（A错）。水湿浸渍之水肿的临床表现主要为全身水肿，下肢明显，按之没指，小便短少，身体困重胸闷，纳呆，泛恶等（B错）。湿毒浸淫之水肿的临床表现主要为眼睑浮肿，延及全身，皮肤光亮，尿少色赤，身发疮痍，甚则溃烂等（C错）。湿热壅盛之水肿的临床表现主要为遍体浮肿，皮肤绷急光亮，胸脘痞闷，烦热口渴，小便短赤，或大便干结等（D错）。